尿毒症患者伴高钾血症最有效降血钾疗法是
A. 口服碳酸钙
B. 必需氨基酸疗法
C. 补充1，25-（OH）₂D₃
D. 促红细胞生成素
E. 血液透析治疗

正确答案：E。血液透析治疗

解析：尿毒症患者伴高钾血症最有效降血钾疗法是血液透析治疗（E对）。血液透析通过弥散或对流的方式进行物质交换，可以快速清除体内的高钾以及各种代谢废物，部分替代肾脏功能。碳酸钙是磷结合剂，口服碳酸钙（A错）主要用于降低血磷。必需氨基酸疗法（B错）作为基础疗法，主要用于改善患者的营养状态、减轻氮质血症。补充1，25-（OH）₂D₃（C错）主要用于纠正低钙血症。促红细胞生成素（D错）主要用于治疗肾性贫血。